屠宰以后的肉品经“后熟产酸”处理可杀死
A. 炭疽杆菌
B. 鼻疽杆菌
C. 口蹄疫病毒
D. 布氏杆菌
E. 结核杆菌

正确答案：C。口蹄疫病毒